某地某年男性简略寿命表中0岁组的期望寿命是65.5岁。在上述寿命表中，若X岁到X﹢1岁的死亡概率为qₓ，X﹢1到X﹢2的死亡概率为qₓ₊₁，则X到X﹢2的死亡概率为
A. 1﹣（1﹣qₓ）×（1﹣qₓ₊₁）
B. （1﹣qₓ）×qₓ₊₁
C. （1﹣qₓ）×（1﹣qₓ₊₁）
D. qₓ×（1﹣qₓ₊₁）
E. qₓ×qₓ₊₁

正确答案：A。1﹣（1﹣qₓ）×（1﹣qₓ₊₁）

解析：本题考查死亡概率的计算。在本题中，若X岁到X﹢1岁的死亡概率为qₓ，X﹢1到X﹢2的死亡概率为qₓ₊₁，则X到X﹢2的死亡概率为1﹣（1﹣qₓ）×（1﹣qₓ₊₁）（A对BCDE错）。